为根治由旁路引发的折返性室上性心动过速，应首选
A. 外科手术
B. 射频消融治疗
C. 抗心动过速起搏器
D. 长期服用有效药物
E. 自动心脏复律除颤器

正确答案：B。射频消融治疗

解析：射频消融（P212）常用于治疗快速性心律失常。射频消融仪通过导管头端的电极释放射频电能，在导管头端与局部心肌内膜之间电能转化为热能，使特定的局部心肌新细胞脱水、变性、坏死，自律性和传导性能均发生改变，从而使心律失常得以根治。其适应证包括预激综合征合并阵发性房颤和快速心室率、房室折返性心动过速、房室结折返性心动过速等。故根治由旁路引发的折返性室上性心动过速应首选射频消融治疗（B对）。在室上性快速性心律失常中，房室结折返性心动过速和房室旁路参与的房室折返性心动过速由于射频消融技术的发展和成功，外科手术治疗（A错）已不再应用。抗心动过速起搏器（C错）价格昂贵，疗效不可预知，并非“治愈性”治疗手段，临床应用应该严格掌握适应证。长期服用有效药物（D错）预防，取决于发作频率程度以及发作的严重性，并非根治方法。自动心脏复律除颤器（P161）（E错）是目前治疗心脏性猝死最有效的方法，不能作为根治由旁路引发的折返性室上性心动过速的首选治疗。